因保存或炮制不当，有效成分水解、氧化变成绿色的药材是
A. 黄芩
B. 黄连
C. 黄柏
D. 姜黄
E. 黄芪

正确答案：A。黄芩

解析：本题考查的是黄芩的理化性质。因保存或炮制不当，有效成分水解、氧化变成绿色的药材是黄芩（A对）。黄芩中的有效成分包含黄芩苷，经水解后生成的黄芩素分子中具有邻三酚羟基，易被氧化转为醌类衍生物而显绿色，这是保存或炮制不当的黄芩能够变绿色的原因。黄连（B错）与黄柏（C错）中的有效成分主要是小檗碱，化学性质比较稳定，不易水解氧化。黄芪（E错）的主要有效成分是黄芪甲苷，属于皂苷类，水解所需条件比较剧烈，通常不易水解。姜黄（D错）的理化性质，2022年考试指南未明确说明。